“寒从中生”的主要机理是
A. 痰湿内阻，从阴化寒
B. 胸阳不振阴寒内盛
C. 恣食生冷，寒伤中阳
D. 肺气不足，寒饮内停
E. 脾肾阳气不足，阴寒内盛

正确答案：E。脾肾阳气不足，阴寒内盛

解析：寒从中生，又称“内寒”，指机体阳气虚衰，温煦气化功能减退，虚寒内生，或阴寒之气弥漫的病机变化，内寒主要与脾肾阳虚有关（E对）；痰湿内阻，从阴化寒、胸阳不振阴寒内盛、恣食生冷，寒伤中阳、肺气不足，寒饮内停均为内寒的病因而不是其机理（ABCD错）。